在非处方药的遴选原则中应用安全是指
A. 重金属限量不超过国内或国际公认标准
B. 在一般贮藏条件下，较长时间不会出现变质或影响疗效
C. 包装内有详细通俗易懂的药品说明书
D. 处方合理，功能主治明确，使用者可根据自己症状选择
E. 经过对药理、药性、剂量和使用结果进行综合评价

正确答案：A。重金属限量不超过国内或国际公认标准

解析：本题考查的是非处方药的遴选原则。在非处方药的遴选原则中应用安全是指重金属限量不超过国内或国际公认标准（A对）。非处方药的遴选原则包括：①应用安全。长期使用证实安全性大；无潜在毒性，不易引起蓄积中毒，中药中的重金属限量不超过国内或国外公认标准；基本无不良反应；不引起依赖性，无“三致”作用；医疗用毒性药品、麻醉药品以及精神药品原则上不能作为非处方药，但个别麻醉药品与少数精神药品可作为“限复方制剂活性成分”使用；组方合理，无不良相互作用，比如中成药组方中无“十八反”“十八畏”等。②疗效确切。药物作用针对性强，功能主治明确（D错）；不需要经常调整剂量；连续使用不引起耐药性。③质量稳定。质量可控、性质稳定。制剂稳定，在有效期限内，一般贮藏条件下，较长时间不会出现变质或影响疗效（B错）。④使用方便。不用经过特殊检查和试验即可使用；以口服和外用的常用剂型为主。包装内有详细且通俗易懂的“药品说明书（C错）”，内容包括药品名称、药物组成、功能主治、用法用量、禁忌症、注意事项、不良反应，以及采取的预防处理措施、贮藏、生产日期、生产厂家等。